成釉器钟状期的细胞成分不包括以上哪项
A. 外釉上皮
B. 内釉上皮
C. 星网状层
D. 中间层
E. 成牙本质细胞层

正确答案：E。成牙本质细胞层

解析：本题考查牙胚的发生及分化。成釉器钟状期的细胞成分不包括成牙本质细胞层（E错，为本题正确答案）。在光镜下，可以把成釉器钟状期分为四层：外釉上皮层（A对）、内釉上皮层（B对）、星网状层（C对）和中间层（D对）。